湿邪致病可见水肿湿疹等，症多见于下肢的主要原因是
A. 湿性趋下
B. 湿性重浊
C. 湿为阴邪
D. 湿性黏滞
E. 湿性疾病缠绵难愈

正确答案：A。湿性趋下

解析：湿性趋下，说明湿邪为病，多易伤及人体下部如水肿、湿疹、脚气等病，以下肢较为多见，《素问·太阴阳明论》说：“伤于湿者，下先受之”（A对）。湿性重浊，常出现以沉重感及附着难移为特征的临床表现，如头身困重、四肢酸楚沉重并且附着难移等（B错）。湿为阴邪，易伤阳气，易阻气机，湿与水同类，故属阴邪，阴邪侵人，机体阳气与之抗争，故湿邪侵袭，易伤阳气（C错）。湿性黏滞的特性主要表现在两个方面：一是症状的黏滞性，湿邪为患，易呈现分泌物和排泄物黏滞不爽的特征，如湿热痢疾的大便排泄不爽，淋证的小便滞涩不畅，以及汗出而黏、口黏和舌苔厚滑黏腻等；二是病程的缠绵性（DE错）。